下列疾病属于虫媒传播的是
A. 钩端螺旋体病
B. 乙肝
C. 伤寒
D. 疟疾
E. 霍乱

正确答案：D。疟疾

解析：病原体离开传染源到达另一个易感者的途径称为传播途径，同一种传染病可以有多种传播途径。常见的传播途径有呼吸道传播、消化道传播、接触传播、虫媒传播、血液体液传播和医源性感染。疟疾在我国最主要传播方式是虫媒传播，传播媒介是中华按蚊，是平原地区疟疾的主要传播媒介；山区由微小按蚊传播，丘陵地区为雷氏按蚊嗜人血亚种，海南岛山林地区为大劣按蚊（D对）。钩端螺旋体病主要是接触传播（A错）。乙肝主要是血液、体液传播（B错）。伤寒和霍乱主要属于消化道传播（CE错）。